牙龈呈重度炎症，不但有色的改变，并且有明显肿胀，探诊后出血，血溢出龈沟，SBI记分为
A. 0
B. 1
C. 2
D. 3
E. 4

正确答案：E。4

解析：4＝牙龈呈重度炎症，不但有色的改变，并且有明显肿胀，探诊后出血，血溢出龈沟。掌握“牙周病流行病学及分级预防”知识点。